决定细菌耐药性的基因是
A. F质粒
B. R质粒
C. Vi质粒
D. Col质粒
E. γ决定因子

正确答案：E。γ决定因子